患者，男，30岁，每年春季出现体发性打喷疃、流涕（清水样）、鼻塞以及眼痒、鼻痒、咽痒等症状。主诉“近日鼻部呼吸不畅，影响睡眠”而就诊。目前考虑该患者最可能的诊断是
A. 普通感冒
B. 流行性感冒
C. 过敏性鼻炎
D. 急性咽炎
E. 哮喘急性发作

正确答案：C。过敏性鼻炎

解析：本题考查过敏性鼻炎的临床表现。过敏性鼻炎（C对）的典型症状为阵发性打喷嚏、流清水样鼻涕、鼻痒和鼻塞，症状出现2个或以上，每天症状持续或累计在1小时以上即可确诊。可伴有眼部症状，包括眼痒、流泪、眼红和灼热感等，多见于花粉过敏患者；随着致敏花粉飘散季节的到来，花粉过敏患者的鼻、眼症状发作或加重。如果致病因素以室内变应原（尘螨、蟑螂、动物皮屑等）为主，症状多为常年发作。